药物经济学中的可变成本包括
A. 医院的床位费
B. 医生门诊时间
C. 医疗设备投资
D. 治疗药品成本
E. 医院房屋折旧

正确答案：B、D。医生门诊时间；治疗药品成本

解析：本题考查的是药物经济学中的成本有机构成。药物经济学中的可变成本包括医生门诊时间（B对）、治疗药品成本（D对）。药物经济学研究的关键步骤之一是区分固定成本和可变成本。固定成本不随治疗措施的变化而变化，例如医院的病床（A错）或医疗设备投资（C错）；可变成本则随着治疗措施的改变而改变，例如医生的门疹时间、病人住院率等。